女，40岁，喝牛奶后常出现腹痛、腹泻等症状。可建议其改用
A. 脱脂奶
B. 高钙奶
C. 炼乳
D. 奶粉
E. 酸奶

正确答案：E。酸奶